治疗痿证湿热浸淫、气血不运证，首选的方剂是
A. 清瘟败毒饮
B. 清燥救肺汤
C. 加味二妙散
D. 参苓白术散
E. 大补阴煎

正确答案：C。加味二妙散

解析：痿证之湿热浸淫证需清热利湿，通利筋脉首选加味二妙散（C对）。清瘟败毒饮（A错）功用为清热解毒，凉血泻火，主治温疫热毒，气血两燔证一般不用于痿证。清燥救肺汤（B错）用于痿证之肺热津伤证以清热润肺，濡养筋脉。脾胃亏虚，精微不运应当健脾益气，补中升阳，选用补中益气汤或参苓白术散（D错）。大补阴煎（E错）主治水肿，肾中水火大亏，服肾气丸不效者，其纯补水火。